阻断白三烯受体，起效缓慢，作用较弱，仅适用于轻、中度哮喘和哮喘稳定期控制的药物是
A. 异丙托溴铵
B. 氟替卡松
C. 孟鲁司特
D. 沙美特罗
E. 茶碱

正确答案：C。孟鲁司特

解析：本题考查孟鲁司特。阻断白三烯受体，起效缓慢，作用较弱，仅适用于轻、中度哮喘和哮喘稳定期控制的药物是孟鲁司特（C对）。孟鲁司特属于白三烯受体阻断剂，白三烯受体阻断剂的起效缓慢，作用较弱，相当于色甘酸钠，一般连续应用4周后才见疗效，且有蓄积性，仅适用于轻、中度哮喘和稳定期的控制。异丙托溴铵（A错）阻断节后迷走神经通路，降低迷走神经兴奋性，产生松弛支气管平滑肌作用，并减少痰液分泌。氟替卡松（B错）酯化后具有强大的抗炎作用，与人体内的糖皮质激素受体具有高度的亲和力，约为地塞米松的18倍。沙美特罗（D错）适用于哮喘（包括夜间哮喘和运动性哮喘）的长期维持治疗，以及12岁以上儿童伴有可逆性气道阻塞的支气管痉挛的预防治疗。茶碱（E错）不良反应多，治疗窗窄，个体差异大，与很多药物存在不良相互作用，已降为二线用药的平喘药物。